下列药物中,具有补虚作用的是
A. 白芨
B. 艾叶
C. 仙鹤草
D. 血余炭
E. 炮姜

正确答案：C。仙鹤草

解析：仙鹤草的功效是收敛止血，止痢，截疟，补虚（C对）。白芨的功效是收敛止血，消肿生肌（A错）。艾叶的功效是温经止血，散寒调经，安胎（B错）。血余炭的功效是收敛止血，化瘀利尿（D错）。炮姜的功效是温经止血，温中止痛（E错）。